金钱草除利尿通淋外，又能
A. 除湿退黄
B. 祛风止痒
C. 凉血止血
D. 清心除烦
E. 破血通经

正确答案：A。除湿退黄

解析：本题考查的是金钱草的功效。金钱草除利尿通淋外，又能除湿退黄（A对）。金钱草：【功效】利水通淋，除湿退黄，解毒消肿。地肤子：【功效】利尿通淋，祛风止痒（B错）。石韦：【功效】利尿通淋，凉血止血（C错），清肺止咳。灯心草：【功效】利尿通淋，清心除烦（D错）。瞿麦：【功效】利尿通淋，破血通经（E错）。